对考核不合格的医师，县级以上人民政府卫生行政部门可以
A. 吊销其医师执业证书
B. 责令其暂停执业活动三个月至六个月，并接受培训和继续教育
C. 降低其执业等级
D. 变更其工作岗位
E. 给予行政或纪律处分

正确答案：B。责令其暂停执业活动三个月至六个月，并接受培训和继续教育

解析：《执业医师法》规定，对考核不合格的医师，县级以上人民政府卫生行政部门可以责令其暂停执业活动三个月至六个月，并接受培训和继续教育（B对），经考核仍不合格的，则注销注册，收回医师执业证书。